全身各种矿化组织中晶体最大的是
A. 釉质中的晶体
B. 骨皮质中的晶体
C. 骨松质中的晶体
D. 软骨中的晶体
E. 牙本质中的晶体

正确答案：A。釉质中的晶体

解析：釉质中的晶体是全身各种矿化组织中晶体最大的，宽约60～70nm，厚约25～30nm，目前一般认为晶体很长，最长者可以贯穿整个釉质的厚度。相比之下，牙本质和骨中的晶体仅为35nm宽，10nm厚。掌握“牙釉质”知识点。